进行大气污染对人群健康影响调查时，现场选择原则中哪一项是错误的
A. 应根据大气调查监测结果和有关资料来选定调查现场
B. 暴露现场要符合调查目的
C. 暴露现场要尽可能避免各种混杂因子
D. 要设立对照区
E. 对照区与暴露现场环境条件要一致

正确答案：E。对照区与暴露现场环境条件要一致

解析：本题考查大气污染对人群健康影响的调查。进行大气污染对人群健康影响调查时，应根据大气调查监测结果及有关资料来选定调查现场（A对）。暴露现场的条件应符合调查目的（B对），尽可能避免各种混杂因子（C对），以保证调查结果的准确性，同时也要重视对照区的选择（D对）。对照区与暴露现场环境条件应相反（E错，为本题正确答案），要尽力查实对照区内不存在排放该污染物的大气污染源，也不宜有来自其他环境介质（水、土等）的同类污染物存在。应了解该地区既往存在的污染源情况，以免某些污染物的慢性有害作用干扰调查结果。